男，65岁。平时有髙血压、糖尿病多年。一天前发现左侧上、下肢活动受限，吐词不清，神志清楚。无明显头痛、呕吐，检査发现左侧上下肢肌力3级，左半身痛觉减退。临床上考虑可能性最大的疾病是
A. 脑出血
B. 脑梗塞
C. 短暂性脑缺血发作
D. 蛛网膜下腔出血
E. 脑血栓形成

正确答案：E。脑血栓形成

解析：本例患者老年男性，平时有高血压、糖尿病（血管慢性损害疾病）多年，一天前发现左侧上、下肢活动受限，吐词不清（TIA前驱症状），神志清楚，无明显头痛、呕吐，检査发现左侧上下肢肌力3级，左半身痛觉减退（轻偏瘫、偏身感觉障碍）。考虑诊断为脑血栓形成（E对）。脑血栓形成多见于中老年，一般有高血压、糖尿病等血管慢性损害疾病，多有肢体麻木、无力等短暂性脑缺血发作（TIA）前驱症状，患者一般意识清楚，当闭塞部位在大脑中动脉深穿支时会表现为对侧均等性轻偏瘫、对侧偏身感觉障碍，优势半球病变可出现皮质下失语（P178）。脑出血（A错）多在情绪激动或活动中突然发病，前驱症状一般不明显，有明显头痛、呕吐症状（P189）。脑梗死（B错）以青壮年多见，多在活动中急骤发病，无前驱症状，多表现为完全性卒中，且有栓子来源病史（P185）。短暂性脑缺血发作（C错）发病突然，症状持续时间一般仅数分钟到数小时，过后完全正常，无后遗症状（P173）。蛛网膜下腔出血（D错）以中青年发病居多，多在剧烈运动、情绪激动等情况下突然起病，有剧烈头痛、呕吐以及典型的脑膜刺激征（P194）。